法洛四联症不应出现的症状是
A. 苍白
B. 蹲踞
C. 晕厥
D. 杵状指（趾）
E. 活动耐力下降

正确答案：A。苍白

解析：法洛四联症临床表现常见的有皮肤黏膜青紫，而非苍白（A错，为本题正确答案），蹲踞（B对）喜抱，活动耐力下降（E对）、杵状指（趾）（D对），当小儿耗氧或需氧增加时会出现阵发性呼吸困难，严重时会出现晕厥（C对）、抽搐，甚至死亡。